第一个被发现的环境致癌物是
A. 多环芳烃
B. 苯并（a）芘
C. 多氯联苯
D. 氡气
E. 氯乙烯

正确答案：B。苯并（a）芘

解析：本题考查第一个被发现的环境致癌物。苯并（a）芘（B对ACDE错）是第一个被发现的环境化学致癌物。